下列属于子宫内膜癌预防措施的是
A. 安全性知识的教育
B. 鼓励应用屏障式避孕方式进行避孕
C. 加强高蛋白、富含维生素A的饮食
D. 预防和积极治疗高血压、糖尿病及其他系统疾病
E. 以上均是

正确答案：D。预防和积极治疗高血压、糖尿病及其他系统疾病

解析：本题考查子宫内膜癌的预防措施。子宫内膜癌的预防措施：（1）普及防癌知识，坚持定期妇科体检。（2）正确掌握使用雌激素的指征。（3）绝经过渡期妇女月经紊乱或不规则阴道流血者应先除外内膜癌。（4）绝经后妇女出现阴道流血警惕内膜癌可能，如出现应进行诊断性刮宫。（5）重视高危患者，预防和积极治疗高血压、糖尿病及其他系统疾病（D对ABCE错），控制体重及脂肪摄入。